碱基类似物
A. N-亚硝基化合物
B. 5-溴脱氧尿嘧啶
C. 亚硝酸根
D. 秋水仙素
E. 青霉素

正确答案：B。5-溴脱氧尿嘧啶